呼吸衰竭患者，血气分析结果为：PaO₂54mmHg，PaCO₂68mmHg，pH7.26，BE为-4mmol/L，HCO₃18mmol/L，其酸碱失衡诊断是
A. 代谢性酸中毒
B. 呼吸性酸中毒
C. 呼吸性酸中毒并代谢性酸中毒
D. 呼吸性酸中毒并代谢性碱中毒
E. 呼吸性碱中毒

正确答案：C。呼吸性酸中毒并代谢性酸中毒

解析：代谢性酸中毒并发呼吸性酸中毒如糖尿病或肾病患者合并肺部广泛性感染或伴发阻塞性肺气肿，实验室检查特征：①血pH值明显降低，表示重症酸中毒。②缓冲碱降低，碱剩余负值增大，表示代谢性酸中毒。③血PaCO₂高于正常，表示呼吸性酸中毒（C对）。代谢性碱中毒是指体内酸性物质经胃肠、肾脏丢失过多，或进入体内的碱过多而导致肾小管HCO₃重吸收过多的原发性血HCO₃升高和pH值升高的一种酸碱平衡紊乱（A错）。呼吸性酸中毒指原发性H₂CO₃潴留，导致血PaCO₂升高和pH＜7.35，血HCO₃⁻代偿性升高（B错）。呼吸性酸中毒并代谢性碱中毒是在慢性呼吸性酸中毒治疗过程中，由于二氧化碳排出过快，补充碱性药物过量；应用糖皮质激素、利尿剂致排钾增加，细胞外钾向细胞内移动，产生低钾血症；呕吐或利尿剂使用，使血氯降低；肾血流量不足，肾小球滤过率下降，碳酸氢根离子重吸收增多等，产生代谢性碱中毒（D错）。呼吸性碱中毒指过度换气引起的动脉血PaCO₂下降和pH＞7.45，血HCO₃-代偿性下降。肾脏于2～6小时后发挥代偿作用，数天后达到最大代偿作用（E错）。